骨髓纤维化可见的是
A. 镰形红细胞
B. 球形红细胞
C. 红细胞大小不均匀
D. 泪滴形红细胞
E. 靶形红细胞

正确答案：D。泪滴形红细胞

解析：骨髓纤维化可见泪滴形红细胞（D对），细胞呈泪滴状或手镜状，还可见于珠蛋白生成障碍性贫血、溶血性贫血等。镰形红细胞（A错）：见于镰状细胞贫血病；球形红细胞（B错）：细胞体积小、圆球形，着色深，中央淡染区消失，主要见于遗传性球形细胞增多症，也可见于自身免疫性溶血性贫血；红细胞大小不均匀（C错）见于病理造血，反映骨髓中红细胞系增生明显旺盛，在缺铁性贫血、溶血性贫血、失血性贫血等贫血达中度以上时，均可见某种程度的红细胞大小不均，而在巨幼细胞贫血时尤为明显；靶形红细胞（E错）：细胞状似射击之靶标，珠蛋白生成障碍性贫血、异常血红蛋白病，靶形细胞常占20%以上，少量也可见于缺铁性贫血、其他溶血性贫血以及黄疸后脾切除的病例。